常用的药品集和药品专著是
A. 《中医大词典》
B. 《中华本草》
C. 《中药常用药品集》
D. 《临床用药须知》
E. 《中国中药资源志要》

正确答案：B、C、D、E。《中华本草》；《中药常用药品集》；《临床用药须知》；《中国中药资源志要》

解析：本题考查的是常用常用药品集和专著。常用的药品集和药品专著是《中华本草》（B对）、《中国常用药品集》（C对）、《临床用药须知》（D对）与《中国中药资源志要》（E对）。常用药品集和专著：1.《中华人民共和国药典临床用药须知》；2.《中华本草》；《中国中药资源志要》；4.《中国常用药品集》；5.《中国药品使用手册•中成药专册》（2002年版）；6.《全国中草药汇编》。《中医大词典》（A错）为常用中医药工具书与文献。常用中医药工具书与文献：1.《中药大辞典》；2.《中国医籍大辞典》；3.《中医方剂大辞典》；4.《中医大辞典》；5.《中国医学文摘——中医》。